下列疾病，对蜘蛛痣有诊断意义的是
A. 肝硬化
B. 麻疹
C. 猩红热
D. 伤寒
E. 药物过敏

正确答案：A。肝硬化

解析：蜘蛛痣是皮肤小动脉末端分支性扩张所形成的血管痣，因形似蜘蛛而得名。蜘蛛痣出现部位多在上腔静脉分布区，如面、颈、手背、上臂、前胸和肩部等处。由于肝硬化（A对）患者雌激素灭活能力减退，故常可出现蜘蛛痣。麻疹（B错）患者可出现丘疹。猩红热（C错）患者可出现斑丘疹。伤寒（D错）患者可出现斑疹。药物过敏（E错）时可出现荨麻疹。